胸痹患者，女，45岁。胸闷如窒而痛，气短喘促，肢体沉重，体胖痰多，舌苔浊腻，脉滑。其证候是
A. 饮邪上犯
B. 痰浊壅塞
C. 心血瘀阻
D. 寒凝气滞
E. 气虚血瘀

正确答案：B。痰浊壅塞

解析：题中患者以胸闷如窒而痛为主症，故诊断为胸痹。痰浊盘踞，胸阳失展，故胸痛如窒而痛；气机痹阻不畅，故见气短喘促；脾主四肢，痰浊困脾，脾气不运，故肢体沉重；体胖痰多，舌苔浊腻，脉滑均为痰浊壅阻之征。故诊断为胸痹痰浊壅塞证（B对）。饮邪上犯可见干呕，吐涎沫，食少神疲等症，无肢体沉重，形体肥胖等症（A错）。心血瘀阻证可见心胸疼痛，如刺如绞，痛有定处，入夜为甚，无肢体沉重，形体肥胖，痰多等症（C错）。寒凝气滞指寒邪凝滞而使气机阻滞的病机，可产生痉挛疼痛等症状，无肢体沉重，形体肥胖，痰多等症（D错）。气虚血瘀可见气短乏力，自汗，脉细弱或结代，无肢体沉重，形体肥胖，痰多等症（E错）。